下列有关RNA的叙述哪项不正确
A. RNA分子也有双螺旋结构
B. tRNA是分子量最小的RNA
C. 胸腺嘧啶是RNA的特有碱基
D. rRNA参与核蛋白体的组成
E. mRNA是生物合成多肽链的直接模板

正确答案：C。胸腺嘧啶是RNA的特有碱基